老年患者对低血糖的耐受能力差，治疗糖尿病时用首选不易导致低血糖反应的降糖药。下列降糖药中，单独使用不会出现低血糖的有
A. 格列齐特
B. 二甲双胍
C. 瑞格列奈
D. 阿卡波糖
E. 吡格列酮

正确答案：B、D、E。二甲双胍；阿卡波糖；吡格列酮

解析：本题考查降糖药的不良反应。单独使用不会出现低血糖的药物有：二甲双胍（B对）、阿卡波糖（D对）、吡格列酮（E对）。格列齐特（A错）、瑞格列奈（C错）单独使用易出现低血糖。